传送食物，搅拌食物，选择食物和辨认异物，压挤食物和清洁作用是
A. 舌在咀嚼中的作用
B. 唇在咀嚼中的作用
C. 颊在咀嚼中的作用
D. 腭在咀嚼中的作用
E. 咽在咀嚼中的作用

正确答案：A。舌在咀嚼中的作用

解析：在咀嚼活动中，舌的形状多变，动作复杂，作用亦非常重要。咀嚼中舌的主要作用有：传送食物，搅拌食物，选择食物和辨认异物，压挤食物和清洁作用。掌握“牙动度和唇、舌、腭对咀嚼的作用”知识点。